教室黑板的宽度中小学校均不应小于
A. 0.2m
B. 0.6m
C. 1.0m
D. 2.0m
E. 3.6m

正确答案：C。1.0m